应用脑室持续引流方法不正确的是
A. 用于脑室系统内脑脊液循环通路梗阻者
B. 用于脑室内出血或脑出血破入脑室不宜开颅手术者
C. 放置脑室引流管应严格无菌操作，位置准确、深度适中、固定良好，保持通畅
D. 脑室内引流管一般高于脑平面20～25cm，引流时间不少于15天
E. 预防感染，每天更换引流袋（瓶）

正确答案：D。脑室内引流管一般高于脑平面20～25cm，引流时间不少于15天

解析：脑室持续引流适用于：①经脑室手术或脑室内肿瘤切除，术后应引流3～5天；②脑室内出血或脑出血破入脑室不宜开颅手术者（B对）；③开颅手术或脊膜膨出修补术后脑脊液漏者；④后颅窝肿瘤病情严重，需改善病情，为手术创造条件者；⑤脑室系统内脑脊液循环通路梗阻者（A对）。脑室持续引流的注意事项包括：⑴放置脑室引流管应严格遵守无菌操作，位置准确、深度适中并固定良好，防止脱出，保持通畅（C对）；⑵预防感染，常规应用抗生素，每天更换引流瓶（袋）（E对）；⑶引流管一般高于脑室平面10～15cm，并注意引流液色泽变化，记录每天的引流量；⑷引流时间一般不宜超过1～2周（D错，为本题正确答案）；⑸停止引流前可夹闭观察24～48小时，如颅压仍高，可改行分流术；⑹要始终观察病情变化。